治疗癫痫
A. 地高辛
B. 奎尼丁
C. 两者均可
D. 两者均不可

正确答案：D。两者均不可